成年男性，三月来双下肢无力，双下肢麻木逐渐发展到腰部，背后疼痛且咳嗽时加剧。查体左半侧T5下痛温觉消失；右下肢肌力Ⅲ°，腱反射亢进，Babinski征阳性，右下肢足趾振动觉位置觉消失。可能的诊断为
A. T8附近脊髓髓内病变
B. 左T8附近脊髓髓外病变
C. 右T3附近脊髓髓外病变
D. T8附近脊髓休克性病变
E. 右T5附近脊髓髓内病变

正确答案：C。右T3附近脊髓髓外病变

解析：脊髓半侧损害表现为病变节段以下患侧上运动神经元瘫痪和深感觉消失以及对侧浅感觉消失。由于脊髓后角纤维在一侧上升2～3个节段后再经白质前连合交叉至对侧，故对侧传导束性感觉障碍平面较脊髓损害节段水平低2～3个节段。本例患者三月来双下肢无力双下肢麻木逐渐发展到腰部，提示髓外病变压迫脊髓（ADE错）。查体右下肢肌力Ⅲ度，腱反射亢进，Babinski征阳性，右下肢足趾振动觉位置觉消失（右下肢上运动神经元瘫痪、深感觉消失），说明脊髓损害在右侧（B错）。左半侧T5下痛温觉（浅感觉）消失，说明脊髓损害部位在右侧T2～3节段，因此诊断该患者为右T3附近脊髓髓外病变（C对）。